患者，女，30岁，已婚。孕后因持重而继发腰酸腹痛，胎动下坠，精神倦怠，脉滑无力。治疗应首选
A. 举元煎
B. 胎元饮
C. 固下益气汤
D. 加味圣愈汤
E. 加味阿胶汤

正确答案：D。加味圣愈汤

解析：患者孕后因持重而继发腰酸腹痛，胎动下坠，是因为劳力所伤，以致气血紊乱，气乱则胎失所载，血乱则胎失所养，是以胎元摄养不固，方药加味圣愈汤以益气养血，固肾安胎（D对）。举元煎功效补气摄血固冲，原方治疗气虚下陷，血崩气脱，亡阳垂危等证，本方实为补中益气汤的缩方，补气力专，多用于气虚较甚之征（A错）。胎元饮功效补气养血，固肾安胎，多用于治疗胎漏胎动不安之气血虚弱证（B错）。固下益气汤功效益气养血，固冲止血，可用于胎漏。妊娠期，阴道少量下血，色淡红，质稀薄，神疲肢倦，面色㿠白，舌淡，苔薄白，脉滑无力（C错）。加味阿胶汤补肾益阳，温煦水液，治疗肾虚小便多等肾虚之证（E错）。